磺胺类抗菌作用机制是
A. 抑制RNA聚合酶
B. 抑制二氢叶酸还原酶
C. 抑制二氢叶酸合成酶
D. 抑制拓扑异构酶IV
E. 抑制肽酰基转移酶

正确答案：C。抑制二氢叶酸合成酶

解析：本题考查药物的作用机制。磺胺类药物的作用机制是抑制二氢叶酸合成酶（C对）。磺胺类药与对氨基苯甲酸化学结构相似，可与PABA竞争二氢叶酸合成酶，阻止二氢叶酸的合成，继而使二氢叶酸和四氢叶酸的合成减少，进而抑制细菌的生长繁殖。